可能与光照有关的疾病是
A. 多形红斑
B. 血管神经性水肿
C. 类天疱疮
D. 盘状红斑狼疮
E. 口角炎

正确答案：D。盘状红斑狼疮

解析：本题考查盘状红斑狼疮的病因。盘状红斑狼疮（D对）其发病可能与太阳光照中的紫外线、免疫学改变、创伤等多种因素有关，这些因素可能会导致盘状红斑狼疮的加重。口角炎（E错）主要与感染、创伤、和营养不良等因素有关，与光照无关。血管神经性水肿（B错）属于过敏性疾病，主要发生在过敏体质的人群，其诱因主要与某些食物、药物、感染因素、精神因素等有关，与光照无关。多形性红斑（A错）也是一种过敏性疾病，其发病可能与使用药物、食入蛋白、接触花粉、病毒感染等因素有关，与光照无关。类天疱疮（C错）目前认为是自身免疫性疾病，与光照无关。